下列不属于评价蛋白质质量的指标是
A. 蛋白质含量
B. 蛋白质消化率
C. 蛋白质生物价
D. 蛋白质净利用率
E. 蛋白质功效比值

正确答案：A。蛋白质含量